适于清晨服用的药品有
A. 沙丁胺醇
B. 泼尼松龙
C. 比沙可啶
D. 帕罗西汀
E. 呋塞米

正确答案：B、D、E。泼尼松龙；帕罗西汀；呋塞米

解析：本题考查药品服用的适宜时间。适于清晨服用的药品有泼尼松龙（B对）、帕罗西汀（D对）、呋塞米（E对）。泼尼松龙属于糖皮质激素，清晨服用可减少对下丘脑-垂体-肾上腺皮质系统的反馈抑制。帕罗西汀属于抗抑郁药，宜于清晨服用。呋塞米属于利尿药，清晨服用可避免夜间排尿次数过多。沙丁胺醇（A错）属于平喘药，睡前服用止喘效果更好。比沙可啶（C错）属于缓泻药，宜于睡前服用。